属于羟甲基戊二酰辅酶A还原酶抑制剂的调节血脂药是
A. 非诺贝特
B. 烟酸
C. 依折麦布
D. 辛伐他汀
E. 阿昔莫司

正确答案：D。辛伐他汀

解析：本题考查调血脂药的分类。辛伐他汀（D对）为羟甲基戊二酰辅酶A还原酶抑制剂类调血脂药，用于高脂血症，冠心病和脑卒中的防治。非诺贝特（A错）为贝丁酸类调血脂药，用于高胆固醇血症（Ⅱa型），内源性高三酰甘油血症，单纯型（Ⅳ）和混合型（Ⅱb和Ⅲ型）。烟酸（B错）为烟酸类调血脂药，用于高脂血症辅助治疗（除Ⅰ型外）。依折麦布（C错）属于胆固醇吸收抑制剂类调节血脂药，用于原发性高胆固醇血症、纯合子家族性高胆固醇血症、纯合子谷甾醇血症。阿昔莫司（E错）为烟酸类调血脂药，用于高三酰甘油血症（Ⅳ型高脂蛋白血症）、高胆固醇血症（Ⅱa型）、高三酰甘油和高胆固醇血症（Ⅱb、Ⅲ及Ⅴ型）。